女，30岁。多汗心悸消瘦3个月，无其他不适，查：甲状腺Ⅱ度弥漫性肿大，T₃、T₄水平升高，TSH水平下降，诊断为甲状腺功能亢进。不适宜的治疗方法是
A. 抗甲状腺药物
B. 免疫抑制剂
C. 放射碘
D. 碘剂和β受体阻滞剂
E. 甲状腺手术

正确答案：B。免疫抑制剂

解析：对于甲状腺功能亢进患者，三种疗法被普遍采用，即抗甲状腺药物（A对）、放射碘（C对）和手术治疗（E对）。碘剂可以减少甲状腺素的释放，主要用于甲状腺手术前的辅助治疗；β受体阻滞剂可阻断甲状腺激素对心脏的兴奋作用，亦可阻断外周组织T₄向T₃转化，可较快控制甲亢症状（D对）。虽然80%以上的甲状腺功能亢进症是由Graves病引起，但目前尚不能对甲亢进行病因治疗，因使用免疫抑制剂效果有限，通常不作为甲亢的常规治疗方法（B错，为本题正确答案）。